丹毒的致病菌是
A. 金黄色葡萄球菌
B. 表皮葡萄球菌
C. 大肠杆菌
D. 产气荚膜梭菌
E. 乙型溶血性链球菌

正确答案：E。乙型溶血性链球菌

解析：丹毒的主要致病菌是乙型溶血链球菌（E对）。金黄色葡萄球菌（A错）多引起疖、痈及转移性脓肿。表皮葡萄球菌（B错）是广泛存在于皮肤表面的条件致病菌，多引起院内感染。大肠杆菌（C错）为肠源性感染常见病原体。产气荚膜梭菌（D错）为气性坏疽的特异性病原菌。